药物在体内蓄积过多时发生危害性反应为
A. 副作用
B. 毒性反应
C. 后遗效应
D. 停药反应
E. 变态反应

正确答案：B。毒性反应

解析：毒性反应是指在剂量过大或药物在体内蓄积过多时发生的危害性反应，一般比较严重。因此，过量用药是十分危险的。毒性反应一般是可以预知的，应该避免发生。掌握“药物不良反应”知识点。